绷带包扎的作用包括
A. 保护术区和创部，防止继发感染，避免再度受损
B. 保温、固定敷料
C. 止血并防止水肿
D. 防止或减轻骨折错位
E. 以上都是

正确答案：E。以上都是

解析：本题考查绷带包扎的作用。绷带包扎的作用包括：1.保护术区和创部，防止污染或继发感染，避免再度受损（A对）。2.止血，并防止水肿（C对）、减轻疼痛。3.防止或减轻骨折错位（D对）。4.保温、固定敷料（B对），防止敷料脱落或移位。综上所述，以上均正确（E对，为本题正确答案）。